影响龋病发生，患者的因素不包括
A. 饮食习惯
B. 地区不同
C. 人群的性别、民族差异
D. 气候条件
E. 年龄差异

正确答案：D。气候条件

解析：影响龋病流行的因素：以上所述地区、年龄、性别、城乡以及民族等龋病流行特征，常受到多种因素的影响。①社会经济因素②氟摄入量③饮食习惯④家族影响。掌握“龋病流行病学”知识点。